下列关于五脏与血液关系的叙述，错误的是
A. 肾精化生血
B. 脾主统血
C. 肝主藏血
D. 肺气助心行血
E. 心调节血量

正确答案：E。心调节血量

解析：血液化生的基础物质是水谷精微和肾精。精与血之间存在着相互资生和相互转化的关系，因为肾精充足，则可化生肝血以充实血液（A对）。脾主统血（B错），是指脾气具有统摄、控制血液在脉中正常运行而不逸出脉外的机能。肝主藏血（C对），是指肝具有贮藏血液、调节血量和防止出血的机能。肺朝百脉，指肺具有辅心行血于周身（D对）的生理机能。全身的血液，通过血脉而流经于肺，经肺的呼吸进行气体交换，而后运行于全身。肝具有调节血量的功能，而非心调节血量（E错，为本题正确答案）。